女性，20岁。持续发热5天，面部出现水肿性皮损，伴膝踝关节肿痛，下肢水肿，有散在瘀点。化验：ESR100mm/h，Hb80g/L，网织红细胞0.1×10⁹/L，Coombs试验（﹢），血小板40×10⁹/L，尿检：蛋白（﹢﹢），RBC5～10/HP本例最可能诊断是
A. 风湿热
B. 慢性肾炎
C. SLE
D. 自身免疫性溶血性疾病
E. ITP

正确答案：C。SLE

解析：该患者发热，水肿，关节肿痛，尿蛋白，血液受累三系减少，溶血性贫血，综上（C对）。风湿热缺乏典型的和特异的临床表现，症状轻重不一，关节炎急性发作时受累关节出现红、肿、灼热、疼痛和活动受限，心脏炎可表现为心肌炎、心内膜炎、心包炎或全心炎，环形红斑常分布于躯干和四肢近端，呈淡红色边缘轻度隆起的环形或半环形红晕，皮下结节为1.5cm～2.0cm的硬性无痛性结节，舞蹈病等，综上风湿热不合题意（A错）。慢性肾炎一般指慢性肾小球肾炎，典型临床表现是蛋白尿、血尿、高血压、水肿，它一般无关节肿痛，而SLE一般是多系统多脏器受累，不合题意（B错）。自身免疫性溶血性贫血临床表现呈多样性，发病发的速度、溶血的程度和病程的变异性都很大。常出现贫血、溶血的临床表现。患者发生溶血危象时，可出现腰背痛、寒战、高热、晕厥、血红蛋白尿等，苍白及黄疸，约见于1/3患者，一般不见水肿（D错）。ITP是原发性免疫性血小板减少症，虽然本题患者血小板数量少于正常值，但ITP多有骨髓巨核细胞增多或正常（E错）。